吸入嗜热放线菌孢子所致疾病是
A. 农民肺
B. 农业皮炎
C. 尾蚴皮炎
D. 钩端螺旋体病
E. 毒毛皮炎

正确答案：A。农民肺

解析：本题考查吸入嗜热放线菌孢子所致疾病。职业性过敏性肺炎是由于吸入被真菌、细菌或动物蛋白等污染的有机粉尘而引起的间质肉芽肿性肺炎。常见的有农民肺（A对BCDE错）、甘蔗肺、蘑菇肺、鸟饲养工肺等。致病因子主要有嗜热性放线菌、干草小多孢菌、烟曲霉菌、蘑菇孢子、鸟或家禽类蛋白等。